患者，胸闷气急3周，胸片示右侧大量胸腔积液，胸穿抽出血性胸水1000ml，LDH580IU/L，考虑胸水的性质为
A. 结核性胸膜炎
B. 癌性胸腔积液
C. 肺炎伴胸腔积液
D. 自发性液气胸
E. 漏出性胸腔积液

正确答案：B。癌性胸腔积液

解析：患者，男，23岁，胸闷气急3周，胸片示右侧大量胸腔积液，胸穿抽出血性胸水1000ml，LDH580IU/L，该患者LDH>500U/L，提示出现恶性肿瘤或并发细菌感染，考虑胸水的性质为癌性胸腔积液（B对）；结核性胸膜炎中ADA多高于45U/L（A错）；肺炎伴胸腔积液，可出现患侧胸部叩诊浊音，语颤减弱，呼吸音减弱（C错）；自发性液气胸，可出现语颤减弱，叩诊过清音或鼓音，心或肝浊音界缩小或消失，听诊呼吸音减弱或消失（D错）；漏出性胸腔积液，外观清澈透明，无色或浅黄色，不凝固（E错）。